患者，女，60岁。因胸闷、胸痛就诊，经检查确诊为急性心肌梗死，同时伴有室性心动过速。纠正其心律失常应首选
A. 胺碘酮
B. 普萘洛尔
C. 利多卡因
D. 维拉帕米
E. 普鲁卡因胺

正确答案：C。利多卡因

解析：急性心肌梗死患者若伴室性心动过速，纠正心律失常应首选利多卡因（C对），如室性心律失常反复可用胺碘酮（A错）治疗。普萘洛尔（B错）和维拉帕米（D错）主要用于治疗急性心肌梗死伴室上性心动过速。普鲁卡因胺（八版药理学P195）（E错）对房性、室性心律失常均有效，但对于急性心肌梗死所致的持续性室性心律失常，其不作为首选。